聚乙烯为
A. 溶蚀性骨架材料
B. 亲水凝胶型骨架材料
C. 不溶性骨架材料
D. 渗透泵型控释片的半透膜材料
E. 常用的植入剂材料

正确答案：C。不溶性骨架材料

解析：本题考查不溶性骨架材料。不溶性骨架材料（C对）是指不溶于水或水溶性极小的高分子聚合物或无毒塑料等。常用的有乙基纤维素（EC）、聚乙烯、无毒聚氯乙烯、乙烯-醋酸乙烯共聚物、硅橡胶等。溶蚀性骨架材料（A错）是指疏水性强的脂肪类或蜡类物质，如动物脂肪、蜂蜡、巴西棕榈蜡、氢化植物油、硬脂醇、单硬脂酸甘油酯、硬脂酸丁酯等。亲水性凝胶骨架（B错）材料可分为4类。①天然胶，如海藻酸盐、琼脂等；②纤维素衍生物，如甲基纤维素（MC）、羧甲基纤维素钠（CMC-Na）、羟丙甲纤维素（HPMC）、羟乙基纤维素（HEC）等；③非纤维素多糖类，如甲壳素、壳聚糖、卡波姆等；④高分子聚合物，如聚维酮（PVP）、聚乙烯醇（PVA）等。渗透泵型控释片的半透膜材料（D错）有醋酸纤维素、乙基纤维素等。常用的植入剂材料（E错）有生物不降解材料硅橡胶。